《中国药典》现定，以木犀草苷和绿原酸为指标成分进行含量测定的药材是
A. 当归
B. 丹参
C. 细辛
D. 金银花
E. 肉桂

正确答案：D。金银花

解析：本题考查的是金银花的化学成分。《中国药典》现定，以木犀草苷和绿原酸为指标成分进行含量测定的药材是金银花（D对）。金银花中主要含有木犀草苷和有机酸类化合物。《中国药典》规定，金银花含木犀草苷不得少于0.050%，含绿原酸不得少于1.5%，含酚酸类的总量不得少于3.8%。当归（A错）中主要含有有机酸类成分、挥发油和多糖类成分。有机酸类成分主要包括阿魏酸、香草酸、烟酸和琥珀酸等。《中国药典》以阿魏酸和挥发油为指标成分进行含量测定，要求阿魏酸含量不得少于0.050%，挥发油含量不得少于0.4%（ml/g）。丹参（B错）中的化学成分主要分为两类：脂溶性的二萜醌类化合物和水溶性的酚酸类成分。二萜醌类化合物大部分为丹参酮型的二萜醌类化合物，包括邻醌型的丹参酮类二萜和对醌型的罗列酮类二萜及其他类型。酚酸类成分主要是丹参素、丹酚酸A、丹酚酸B、丹酚酸C、迷迭香酸、原儿茶酸、紫草酸单甲酯，其中丹酚酸B是丹参中酚性酸的主要成分。《中国药典》要求测定丹参中丹参酮类和丹酚酸B的含量。辽细辛（C错）的主要化学成分为挥发油、木脂素类和黄酮类等。挥发油约占其含量的3%。《中国药典》以细辛脂素为指标成分进行含量测定，含量不得少于0.050%。同时规定挥发油不得少于2.0%（ml/g）。肉桂（E错）皮含挥发油1%～2%。《中国药典》以桂皮醛为指标成分进行含量测定，并以挥发油作为质量控制指标，要求其含量不得少于1.2%（ml/g）。